对胎儿骨骼发育可能产生不良反应，妊娠期妇女避免使用的药品是
A. 左氧氟沙星
B. 氯霉素
C. 磷霉素
D. 万古霉素
E. 甲硝唑

正确答案：A。左氧氟沙星

解析：本题考查妊娠期用药。对胎儿骨骼发育可能产生不良反应，妊娠期妇女避免使用的药品是左氧氟沙星（A对）。对胎儿有致畸或明显毒性作用，如四环素类可致胎儿齿及骨骼发育不良，氟喹诺酮类致胎儿软骨损害，妊娠期避免应用。氯霉素（B错）在乳汁中的浓度为血清中的一半，有明显骨髓抑制作用，可引起灰婴综合征，故哺乳期禁用。磷霉素（C错）存在于母乳中，哺乳期妇女慎用，用药时暂停哺乳。万古霉素（D错）为糖肽类抗菌药物，对革兰阳性菌有强大的抗菌活性。可导致听力减退，甚至耳聋。妊娠期妇女应避免使用。甲硝唑（E错）禁用于妊娠期妇女及哺乳期妇女。